按照《抗菌药物临床应用管理办法》，价格昂贵的抗菌药物属于
A. 非限制使用级
B. 禁止使用级
C. 限制使用级
D. 特殊使用级

正确答案：D。特殊使用级

解析：本题考查的是抗菌药物分级和分级标准。按照《抗菌药物临床应用管理办法》，价格昂贵的抗菌药物属于特殊使用级（D对）。抗菌药物分级和分级标准：抗菌药物临床应用应当遵循安全、有效、经济的原则。抗菌药物临床应用实行分级管理。根据安全性、疗效、细菌耐药性、价格等因素，将抗菌药物分为三级：非限制使用级、限制使用级与特殊使用级。具体划分标准如下。（1）非限制使用级（A错）：经长期临床应用证明安全、有效，对细菌耐药性影响较小，价格相对较低的抗菌药物。（2）限制使用级（C错）：经长期临床应用证明安全、有效，对细菌耐药性影响较大，或者价格相对较高的抗菌药物。（3）特殊使用级：主要包括以下几类：①具有明显或者严重不良反应，不宜随意使用的抗菌药物；②需要严格控制使用，避免细菌过快产生耐药的抗菌药物；③疗效、安全性方面的临床资料较少的抗菌药物；④价格昂贵的抗菌药物。